关于干扰素α治疗病毒性乙型肝炎的说法，错误的是
A. 用药1周内多数患者会出现流感样症状
B. 需要监测血常规
C. 可引起甲状腺功能异常
D. 若患者出现明显流感样症状，应立即停药
E. 用药期间若出现神经精神症状，应及时就诊

正确答案：D。若患者出现明显流感样症状，应立即停药

解析：本题考查干扰素α。关于干扰素α治疗病毒性乙型肝炎的说法，错误的是若患者出现明显流感样症状，应立即停药（D错，为本题正确答案）。干扰素α主要不良反应的处理：（1）流感样症状：表现为用药1周内几乎所有患者都会出现流感样症状（A对），症状不明显者可不予处理；症状明显者建议休息，多饮水，睡前注射干扰素α可减轻流感样症状。（2）外周血细胞减少：本药所致的中性粒细胞计数和血小板计数下降常为一过性，使用时需要监测血常规（B对）。（3）神经精神系统反应：治疗过程中出现情绪低落、焦虑和易怒的患者应及时诊治（E对），神经精神症状严重者或药物不能控制的患者应及时停用干扰素α。（4）甲状腺功能异常（C对）等自身免疫紊乱现象：干扰素α治疗期间应密切监测甲状腺功能、TPOAb和TGAb。（5）糖尿病：干扰素α治疗前应积极控制糖尿病症状；治疗期间应定期监测血糖水平。（6）其他不良反应：可对症治疗，一些患者可出现自身抗体，仅少部分患者发生银屑病、白斑病、类风湿关节炎和系统性红斑狼疮样综合征等自身免疫异常疾病，应及时就诊，严重者须停药；出现少见的严重不良反应如肾脏损害、心血管并发症、视网膜病变、听力下降和间质性肺炎等，须停止干扰素α治疗。